铸造间隙卡环深度和宽度为
A. 0.9mm
B. 1mm
C. 1.3mm
D. 1.5mm
E. 2mm

正确答案：D。1.5mm

解析：弯制钢丝间隙卡环隙卡沟的深度和宽度为0.9～1mm，铸造间隙卡环和联合卡环的隙卡沟深度和宽度为1.5mm。掌握“局部义齿修复前的准备及牙体预备”知识点。